具有益肾固精，养心安神功效的药物是
A. 枸杞子
B. 五倍子
C. 莲子
D. 诃子
E. 金樱子

正确答案：C。莲子

解析：莲子甘补涩敛，平而不偏，入脾、肾、心经，补虚与固涩兼具，为药食两用之品。味甘而涩，入肾经能益肾固精。入心肾经，能养心益肾，交通心肾而宁心安神（C对）。枸杞子（A错）功效为滋补肝肾，益精明目。五倍子（B错）功效为敛肺降火，涩肠止泻，敛汗，固精止遗，止血，收湿敛疮。诃子（D错）功效为涩肠止泻，敛肺止咳，降火利咽。金樱子（E错）功效为固精缩尿，固崩止带，涩肠止泻。